今研制成一种预防某种传染病的新疫苗，为观察该疫苗的流行病学预防效果，你准备选择的观察人群是
A. 预期患病率低的人群
B. 免疫水平高的人群
C. 预期发病率低的人群
D. 预期发病率高的人群
E. 隐性感染率高的人群

正确答案：D。预期发病率高的人群